关于骨下袋的描述，哪一项是错误的
A. 多伴有（牙合）创伤存在
B. 袋底位于骨嵴顶的根方
C. 牙槽骨垂直吸收
D. 越隔纤维从袋底牙骨质越过嵴顶附着于邻牙牙骨质
E. 牙龈增生肥大

正确答案：E。牙龈增生肥大

解析：本题考查骨下袋。牙龈增生肥大（E错，为本题正确答案）常见于增生性龈炎。骨下袋是一种真性牙周袋，袋底位于牙槽嵴顶的根方（B对），袋壁软组织位于牙根面和牙槽骨之间，也就是说，牙槽骨构成了牙周袋的一部分。骨下袋牙槽骨垂直吸收（C对），牙槽骨与牙根面之间形成一定角度。多伴有（牙合）创伤存在（A对），（牙合）创伤可促进牙槽骨的垂直吸收。骨下袋越隔纤维从袋底牙骨质越过嵴顶附着于邻牙牙骨质（D对），固位能力下降，牙齿容易松动。